一项食盐量与高血压关联的病例对照研究资料，经分析后获如下数据：X²＝12.26，p＝0.01，OR＝3.4，正确的研究结论是
A. 高盐者患高血压病可能性明显大于低盐者
B. 高盐组高血压病患病率明显大于低盐组
C. 高盐组患高血压病可能性明显小于低盐组
D. 高盐组高血压病发病率明显大于低盐组
E. 低盐组高血压病发病率明显大于高盐组

正确答案：A。高盐者患高血压病可能性明显大于低盐者